患者胸胁胀闷，嗳气食少，每因抑郁恼怒之时，发生腹痛泄泻，舌淡红，脉弦。其治法是
A. 调理脾胃
B. 疏肝理气
C. 抑肝扶脾
D. 泻肝和胃
E. 疏肝和胃

正确答案：C。抑肝扶脾

解析：患者每因抑郁恼怒之时，发生腹痛泄泻可诊断为泄泻。肝失疏泄，横逆乘脾，失其健运，故腹痛泄泻；肝失疏泄故胸胁胀闷，嗳气食少。故为肝气乘脾证，应抑肝扶脾（C对）。调理脾胃用于脾胃虚弱证（A错）。泄泻治法无疏肝理气（B错）。泄泻治法无泄肝和胃（D错）。泄泻治法无疏肝和胃（E错）。